女，25天。不明原因反复惊厥发作3次。首选的止惊药物是
A. 地西泮
B. 苯巴比妥
C. 苯妥英钠
D. 异丙嗪
E. 硫喷妥钠

正确答案：B。苯巴比妥

解析：对于多次反复发作的惊厥，可长期口服苯巴比妥（B对），以防再次发作，请注意，控制新生儿惊厥首选苯巴比妥。地西泮（A错）起效快，但维持时间短。苯妥英钠（C错）是治疗癫痫大发作和局限性发作的首选药物。异丙嗪（D错）是吩噻嗪类抗组胺药，也可用于镇吐、抗晕动以及镇静催眠。硫喷妥钠（E错）与苯巴比妥同属于巴比妥类，在治疗惊厥时不作为首选用药。